最早制作针灸铜人模型的医家是
A. 皇甫谧
B. 孙思邈
C. 王惟一
D. 杨继渊
E. 李学川

正确答案：C。王惟一

解析：皇甫谧的《针灸甲乙经》收录349个腧穴的名称、定位和刺灸法，并对各科病证的针灸治疗进行了归纳和论述（A错）。孙思邈的《备急千金要方》广泛收集了前代针灸医家的经验和个人体会，绘制了“明堂三人图”（B错）。王惟一对腧穴进行了重新考订，确立了354个经穴，著《铜人腧穴针灸图经》，随后设计了两具铜人模型，外刻经络腧穴，内置脏腑，供针灸教学和考试使用（C对）。杨继洲的《针灸大成》是继《针灸甲乙经》后对针灸学的第三次总结（D错）。李学川的《针灸逢源》汇集了各家针灸医学学术思想的精华，考订了一些经穴的错误（E错）。